下列不是急性HIV感染的临床表现的是
A. 发热
B. 乏力
C. 淋巴结肿大
D. 口腔真菌感染
E. 皮疹

正确答案：D。口腔真菌感染

解析：本题考查急性HIV感染的临床表现。急性HIV感染人体后，临床表现为发热（A对）、皮疹（E对）、淋巴结肿大（C对）、乏力（B对）等。口腔真菌感染（D错，为本题正确答案）不是急性HIV感染的临床表现。